情绪与情感的区别方向是
A. 从反应上看
B. 从发生上看
C. 从进化上看
D. 对需要的满足
E. 以上说法均正确

正确答案：E。以上说法均正确

解析：情绪与情感的区别：①对需要的满足：情绪与生理性需要相联系；情感是与人的社会性需要相联系的体验。②从进化上看：情绪代表感情的种系发展的原始方面，人与动物共有；情感是人才有的高级心理现象，是人类社会历史发展的产物。③从发生上看：情绪受情境影响大，不稳定；情感受情境影响小，较稳定。④从反应上看：情绪反应强烈，外部表现明显；情感反应较深沉，外部表现不明显。掌握“情绪过程”知识点。